患者腹部膨隆呈球形，转动体位时形状改变不明显，应首先考虑的是
A. 肝硬化
B. 右心功能不全
C. 缩窄性心包炎
D. 肾病综合征
E. 肠麻痹

正确答案：E。肠麻痹

解析：患者腹部膨隆呈球形，转动体位时形状改变不明显，应首先考虑的是肠麻痹（E对）。肝硬化（A错）、右心功能不全（B错）、缩窄性心包炎（C错）、肾病综合征（D错）均可引起腹腔积液，从而导致全腹膨隆，但坐位时下腹部明显膨出。